可以在大众媒介发布广告的药品是
A. 氯雷他定片（OTC）
B. 艾司唑仑片
C. 阿奇霉素分散片（抗菌药）
D. 曲马多片
E. 复方樟脑酊（医院制剂）

正确答案：A。氯雷他定片（OTC）

解析：本题考查药品广告管理。精神药品、军队医疗机构配制的制剂、麻醉药品及处方药均不能发布广告，氯雷他定（A对）为非处方药，可以发布广告。